属于血管紧张素Ⅱ受体阻断剂的药品是
A. 依那普利
B. 替米沙坦
C. 哌唑嗪
D. 塔罗新（坦索罗辛）
E. 阿利克仑（阿利吉仑）

正确答案：B。替米沙坦

解析：本题考查血管紧张素Ⅱ受体阻断剂。替米沙坦（B对）属于血管紧张素Ⅱ受体阻断剂。抗高血压可分为：血管紧张素转换酶抑制剂，代表药为卡托普利、依那普利、雷米普利、福辛普利；血管紧张素Ⅱ受体阻断剂，代表药为缬沙坦、厄贝沙坦、坎地沙坦；肾素抑制剂；其它抗高血压药代表药为利血平、甲基多巴、硝普钠。